患儿咳嗽连声，持续1月余，每日阵咳10余次，朝轻夜重，咳剧时伴有深吸气样鸡鸣声，甚则呕吐痰涎乳食。治疗应首选
A. 桑白皮汤
B. 五虎汤
C. 葶苈大枣泻肺汤
D. 麻杏石甘汤
E. 清宁散

正确答案：A。桑白皮汤

解析：患儿咳嗽连声，每日阵咳10余次，朝轻夜重，咳剧时伴有深吸气样鸡鸣声，当属百日咳.其痰火阻肺故见咳嗽甚则呕吐痰涎乳食，治宜泻肺清热，涤痰镇咳，方用 桑白皮汤合葶苈大枣泻肺汤加减，选项中只有两个单方，葶苈大枣泻肺汤功能泻肺平喘，更擅于治疗肺痈，而桑白皮汤功能清肺降气，化痰止嗽，为最佳选项（A对C错）。五虎汤功能开肺定喘，合葶苈大枣泻肺汤用于肺炎喘嗽之痰热闭肺证（B错）。麻杏石甘汤功能辛凉宣肺，清热化痰，合银翘散可用于肺炎喘嗽之风热闭肺证（D错）。清宁散功能清肺化痰，用于痰热咳嗽（E错）。